股四头肌
A. 起自股骨前面
B. 肌腱延续为髌韧带
C. 止于胫、腓骨上端
D. 伸髋关节
E. 参与围成股三角

正确答案：B。肌腱延续为髌韧带

解析：股四头肌起自髂前下棘、股骨粗线内外侧唇、股骨体前面，而非仅起自股骨前面（A错），止于胫骨粗隆，而非胫、腓骨上端（C错），屈髋关节和伸膝关节，而非伸髋关节（D错），肌腱延续为髌韧带（B对），与股三角的围成无关（E错）。